肾上腺髓质激素大量释放时
A. 血压升高，心率加快
B. 血压降低，心率加快
C. 血压升高，心率减慢
D. 血压降低，心率减慢
E. 血压和心率均不变

正确答案：A。血压升高，心率加快

解析：肾上腺髓质激素大量释放主要是在应急反应时发生，引起中枢神经系统兴奋增强，心率加快，心输出量增加，血压升高（A对），使全身血量重新分布，以确保心、脑与肌肉等器官的血流量增加。呼吸加快加深，血糖升高，脂肪分解，葡萄糖、脂肪氧化增强，以满足机体在紧急情况下急增的能量需求。